必须根据病情，采取必要的治疗和控制传播措施的是
A. 鼠疫、霍乱和炭疽病人
B. 甲类传染病人和病原携带者、乙类传染病病人中的传染性非典型肺炎病人，炭疽中的肺炭疽病人
C. 对疑似甲类传染病病人
D. 乙类或者丙类传染病病人
E. 肝硬化病人

正确答案：D。乙类或者丙类传染病病人

解析：本题考查传染病预防与控制。必须根据病情，采取必要的治疗和控制传播措施的是乙类或者丙类传染病病人（D对）。鼠疫、霍乱和炭疽病人（A错）在死亡后必须将尸体立即消毒，就近火化。甲类传染病人和病原携带者、乙类传染病病人中的传染性非典型肺炎病人，炭疽中的肺炭疽病人（B错）须予以隔离治疗。对疑似甲类传染病病人（C错）在明确诊断前，在指定场所进行医学观察。肝硬化病人（E错）须采取血液-体液隔离，以切断传播途径。